世界卫生组织推荐在用于牙周病流行病学调查的指数是
A. SBI
B. PD
C. CPITN
D. AL
E. PLI

正确答案：C。CPITN

解析：本题考查评价牙周健康的指数-社区牙周指数。社区牙周指数（CPITN）反映牙周组织的健康状况，也反应牙周治疗需要情况，操作简单，被世界卫生组织采纳，推荐作为牙周病流行病学调查指数（C对）。SBI为龈沟出血指数，龈炎时，一般都有红肿现象，但龈沟出血则是龈炎活动期的表现（A错）；PB为探诊深度，单纯探诊不能确定是否为牙龈炎或牙周炎（B错）。AL为附着丧失，反应牙周支持组织的破坏程度（D错）；PLI为菌斑指数，用于评价口腔为何状况和衡量牙周病防治效果（E错）。